症状性癫痫的定义是指
A. 临床上不能分类的癫痫
B. 从婴儿起始的癫痫
C. 抗癫痫药物无法控制的癫痫
D. 脑部无病损或代谢异常的癫痫
E. 脑部有病损或代谢异常的癫痫

正确答案：E。脑部有病损或代谢异常的癫痫

解析：癫痫按病因分类可分为三大类：（1）症状性癫痫：脑部有病损或代谢异常的癫痫（E对）；（2）特发性癫痫：病因不明，脑部无病损或代谢异常的癫痫（D错）；（3）隐源性癫痫：临床表现提示症状性癫痫，但现有检查手段不能发现明确的病因。临床上不能分类的癫痫（A错）属于癫痫发作分类的第三类即不能分类的发作。从婴儿起始的癫痫（B错）属于与年龄密切相关的特发性癫痫中的婴儿痉挛症。抗癫痫药物无法控制的癫痫（C错）主要见于假性癫痫发作。